皮下脂肪瘤的常见肉眼形态是
A. 分叶状
B. 乳头状
C. 结节状
D. 囊状
E. 菜花状

正确答案：A。分叶状

解析：脂肪瘤是最常见的良性软组织肿瘤，好发于背、肩、颈及四肢近端皮下组织，外观常呈分叶状（A对）（P98）。乳头状癌（B错）是甲状腺癌中最常见的类型（P315）。肉眼观呈结节状（C错）可见于脂肪肉瘤、血管瘤等疾病（P99）。肉眼观呈囊状（D错）可见于囊腺瘤或囊腺癌等疾病（P97）。肉眼观呈菜花状（E错）可见于宫颈癌等疾病（P286）。